乙胺丁醇的主要不良反应是
A. 结晶尿
B. 球后视神经炎
C. 周围神经炎
D. 肝脏损害
E. 耳毒性

正确答案：B。球后视神经炎

解析：乙胺丁醇为人工合成的抗结核杆菌药，其作用机制为与二价金属离子如Mg²⁺络合，阻止菌体内亚精胺与Mg²⁺结合，干扰细菌RNA的合成，对繁殖期结核杆菌有较强的抑制作用，临床可用于各型肺结核和肺外结核，特别适用于经链霉素和异烟肼治疗无效的病人，其安全性高、不良反应发生率低、耐药性产生慢，目前已经取代水杨酸钠成为一线的抗结核药，治疗剂量下安全，但连续大量使用2-6个月可产生严重毒性反应，如球后视神经炎（B对）引起的弱视、红绿色盲和视野缩小。磺胺类抗菌药可引起泌尿系统损害，出现结晶尿（A错）、血尿、疼痛、尿闭等症状。抗结核药异烟肼常见的不良反应为周围神经炎（C错），表现为手脚麻木、肌肉震颤和步态不稳等，大剂量可出现头痛、头晕、兴奋和视神经炎，严重时可导致中毒性脑病和精神病。抗结核药异烟肼可利福平易出现肝脏损害（D错），合用应定期检查肝功能。氨基糖苷类抗生素具有严重的肾毒性和耳毒性（E错）。